男，17岁。发热伴乏力，纳差，眼黄，尿黄5天。实验室检查：ALT860U/L，AST620U/L，TBil60μmol/L。经常在街边小摊进餐。曾注射乙肝疫苗。本患者所患疾病的病原属于
A. 单股负链RNA病毒
B. 双股RNA病毒
C. 单股正链RNA病毒
D. DNA病毒
E. 小RNA病毒

正确答案：C。单股正链RNA病毒

解析：患者青少年男性，急性发病过程，有摄入可疑不洁食物史（甲型肝炎和戊型肝炎的主要感染途径），发热伴乏力，纳差，眼黄，尿黄5天（急性黄疸型肝炎常见表现）。实验室检查：ALT860U/L（正常ALT5～40U/L），AST620U/L（正常AST8～40U/L），TBil60μmol/L（正常TBil3.4～17.1μmol/L）。结合病史、症状和实验室检查。考虑诊断为可初步“”诊断为急性黄疸型肝炎。病原体为经消化道传染的HAV（单股线状RNA病毒）和HEV（单股正链RNA病毒）（C对），且曾注射过乙肝疫苗，故感染经体液传染的HBV（DNA病毒）（D错）、HCV（单股正链RNA病毒）、HDV（单股环状闭合负链RNA病毒）（A错）的可能性较小。